患者年高体衰，病属虚寒，久已卧床不起。今日晨起突然面色泛红，烦热不宁，语言增多，并觉口渴，舌淡，脉大而无根。其病机是
A. 阴盛格阳
B. 阳虚阴盛
C. 阳损及阴
D. 阳气亡失
E. 阴阳离决

正确答案：E。阴阳离决

解析：“患者年高体衰，病属虚寒，久已卧床不起。今日晨起突然面色泛红，烦热不宁，语言增多，并觉口渴、舌淡，脉大而无根”是由于病人久病，脏腑精气极度衰竭，正气将脱，阴不敛阳，虚阳外越，阴阳即将离决（E对）所致，常是危重病人临终前的征兆。